可引起某病的患病率与发病率比值加大的情况为
A. 该病病死率增高
B. 该病病程缩短
C. 该病病程延长
D. 该病治愈率提高
E. 该病的发病率增高

正确答案：C。该病病程延长

解析：本题考查引起患病率与发病率比值升高的情况。患病率取决于两个因素，即发病率、和病程。三者的关系是：患病率＝发病率×病程。当某病病程延长（C对ABDE错）时，可引起该病的患病率与发病率比值升高。